男，24岁。发热伴心前区锐痛3天，3天前出现发热，体温38℃左右，伴心前区锐痛，休息后未减轻。既往体健。查体：BP100/60mmHg，双肺呼吸音清，心率107次/分，胸骨左缘第3肋间可闻及粗糙的双相性搔刮样声音。该患者疼痛最可能的病因是
A. 肺癌
B. 气胸
C. 主动脉夹层
D. 急性心包炎
E. 急性心肌梗死

正确答案：D。急性心包炎

解析：青年男性患者，发热伴心前区锐痛3天，3天前出现发热，体温38℃左右（体温正常值36℃～37.3℃，提示感染，急性心包炎的常见病因），休息后未减轻。查体：BP100/60mmHg（正常值90～120/60～80mmHg），双肺呼吸音清，心率107次/分（正常60～100次/分），胸骨左缘第3肋间可闻及粗糙的双相性搔刮样声音（即心包摩擦音，急性心包炎最具有诊断价值的体征），结合患者症状、体征，考虑诊断为急性心包炎（D对）。肺癌（A错）常出现于老年人，主要出现咳嗽，咳血痰等肺部表现。气胸（B错）（P120）多起病急骤，患者突感一侧胸痛，针刺样或刀割样，继之胸闷和呼吸困难。主动脉夹层（C错）（P324）主要表现为突发前胸或胸背部持续性、撕裂样剧痛，可放射到肩背部，且常伴高血压。急性心肌梗死（E错）出现心肌梗死后综合征并发症时，也可出现发热胸骨左缘第3肋间可闻及搔刮样声音，但常发生于梗死后数周至数月，且其主要表现为突发胸骨后压榨性疼痛、气喘、大汗淋滴等。